患儿昨日起流涕，咳嗽，夜间突发喘促，咳痰稀白，呼气延长，喉中哮鸣，脉浮滑。其证候是
A. 风寒闭肺
B. 风寒感冒
C. 风寒咳嗽
D. 寒性哮喘
E. 痰浊阻肺

正确答案：D。寒性哮喘

解析：患儿夜间突发喘促，呼气延长，喉中哮鸣，当属于哮喘（D对）。风寒闭肺，肺气不宣，气机阻滞，可见发热恶寒，无汗，咳嗽，鼻塞流涕等（A错）。风寒感冒以恶寒，无汗，鼻流清涕，咽不红，脉浮紧或指纹浮红为特征（B错）。风寒咳嗽见咳嗽频作，喉痒声重，痰白清稀（C错）。痰浊阻肺可见咳嗽痰多，痰黏难咳（E错）。